Kennedy第一类缺失中黏膜支持式义齿的具体措施不正确的是
A. 排瓷牙
B. 加深食物排溢沟
C. 减少人工牙数目
D. 在基托组织面衬垫软塑料
E. 不妨碍口腔组织功能的情况下，尽可能扩大基托面积

正确答案：A。排瓷牙

解析：黏膜支持式义齿：当两侧后牙全部缺失，余留牙牙周情况差时，才设计成黏膜支持式义齿。黏膜支持恢复的咀嚼功能较差，在临床上尽量少设计此类义齿。具体措施a.减少人工牙数目，两侧可少排一个前磨牙或磨牙，使牙列变短；减小人工牙的颊舌径、近远中径，降低人工牙的牙尖高度；b.排塑料牙；c.在不妨碍口腔组织功能的情况下，尽可能扩大基托面积，可达到分散（牙合）力，增加义齿固位，防止鞍基下沉的目的；d.加深食物排溢沟；e.必要时，在基托组织面衬垫软塑料，以缓冲（牙合）力，减轻或消除黏膜压痛、创伤。掌握“局部义齿的设计”知识点。